女，27岁，主诉：近2个月来，发现全口牙龈普遍增生。临床：全口牙龈增生肥大，覆盖牙面的1/2甚至更多，质地中等，颜色呈灰白色。采集病史时，应重点询问的病史，除外
A. 牙龈自动出血史
B. 癫痫史
C. 偏侧咀嚼史
D. 家族史
E. 近来全身身体状况

正确答案：C。偏侧咀嚼史

解析：本题考查牙龈增生肥大的病因。女，27岁，主诉：近2个月来，发现全口牙龈普遍增生。临床：全口牙龈增生肥大，覆盖牙面的1/2甚至更多，质地中等，颜色呈灰白色。采集病史时，应重点询问的病史，除外偏侧咀嚼史（C错，为本题的正确答案）。偏侧咀嚼不会造成牙龈的增生肥大。导致牙龈增生肥大的疾病可能为①药物牙龈肥大，可导致牙龈增生肥大的药物有抗癫痫药物（B对）—苯妥英钠，免疫抑制剂—环孢素，钙通道阻断剂—硝苯地平、维拉帕米；②牙龈纤维瘤病，该病有家族遗传史（D对）；③白血病造成的牙龈病损，牙龈有明显的出血倾向（AE对）。